局部用药治疗龋病的常见适应证是
A. 小而深的乳牙龋
B. 大而浅的乳牙龋
C. 大而深的乳牙龋
D. 乳前牙邻面龋
E. 乳磨牙邻面龋

正确答案：B。大而浅的乳牙龋

解析：药物治疗龋病适用于：龋损面广泛的浅龋或剥脱状的环状龋，不易制备洞形的乳牙。常见于乳前牙的邻面和唇面，乳磨牙的（牙合）面和颊面。掌握“年轻恒牙龋”知识点。